左上12345因颌骨囊肿拔除，基牙稍有松动，可选择
A. 腭杆
B. 腭板
C. 舌托
D. 舌面板
E. 树脂基托

正确答案：E。树脂基托

解析：树脂基托有助于美观。掌握“局部义齿连接体”知识点。